何者除外
A. 硬瘫
B. 腱反射亢进
C. 病理反射阳性
D. 肌肉容易萎缩
E. 腹壁反射消失

正确答案：D。肌肉容易萎缩

解析：上运动神经元损伤后的瘫痪特点表现为：随意运动障碍；肌张力增高，故称痉挛性瘫痪（硬瘫）（A对D错，为本题正确选项）；腱反射亢进（因失去高级控制）（B对），浅反射（如腹壁反射、提睾反射等）减弱或消失（因锥体束的完整性被破坏）（E对）；病理反射阳性（C对）。